通过普查可实现的研究目的是
A. 为了早发现、早诊断、早治疗宫颈癌
B. 对个别发生的麻疹患者进行调查
C. 烟草消耗量与肺癌的关系研究
D. 对临床诊疗过程中遇见的某罕见疾病病例的临床表现、治疗与转归等进行描述
E. 为了获取某地高校学生的乙肝感染率

正确答案：A。为了早发现、早诊断、早治疗宫颈癌

解析：本题考查普查的目的。普查的目的主要包括：①早期发现、早期诊断和早期治疗病人，如妇女的宫颈癌普查（A对BCDE错）；②了解慢性病的患病及急性传染性疾病的疫情分布，如高血压普查和针对疫区开展的普查；③了解当地居民健康水平，如居民膳食与营养状况调查；④了解人体各类生理生化指标的正常值范围，如青少年身高、体重的测量等。